根据《执业药师资格制度暂行规定》，执业药师注册有效期为
A. 一年
B. 二年
C. 三年
D. 四年
E. 五年

正确答案：E。五年

解析：本题考查的是执业药师注册要求。根据《执业药师资格制度暂行规定》，执业药师注册有效期为五年（E对）。执业药师注册有效期为五年。需要延续的，应当在有效期届满三十日前，向所在地注册管理机构提出延续注册申请。